小儿头围与胸围大致相等的年龄是
A. 6个月
B. 1岁
C. 1.5岁
D. 2岁
E. 2.5岁

正确答案：B。1岁

解析：1岁时儿童的头围和胸围约为46cm，介时头围与胸围的增长在生长曲线上形成头、胸围的交叉（B对）。